O/W乳膏剂中常用的乳化剂是
A. 月桂醇硫酸钠
B. 羊毛脂
C. 丙二醇
D. 羟苯乙酯
E. 凡士林

正确答案：A。月桂醇硫酸钠

解析：本题考查乳化剂。月桂醇硫酸钠（A对）是O/W乳膏剂常用的乳化剂；羊毛脂（B错）是W/O型乳膏剂的乳化剂；多元醇类（C错）是一种保湿剂；羟苯酯类（D错）是常用的防腐剂；凡士林（E错）是乳膏剂常用的油性基质。